乳痈切开排脓的切口应该是
A. 切口尽量大
B. 切口宜高
C. 纵切口
D. 横切口
E. 按乳络方向

正确答案：E。按乳络方向

解析：在外治法中，当乳痈脓肿形成时，应在波动感及压痛明显处及时切开排脓。切口应按乳络方向并与脓腔基底大小一致（E对）（ACD错），切口位置应选择脓肿稍低的部位，使引流通畅而不致形成袋脓（B错）。